5749-2006）要求阴离子合成洗涤剂含量不超过
A. 0.1mg/L
B. 0.3mg/L
C. 0.9mg/L
D. 2.7mg/L
E. 5.4mg/L

正确答案：B。0.3mg/L

解析：本题考查《生活饮用水卫生标准》（GB 5749-2006）要求的阴离子合成洗涤剂含量。《生活饮用水卫生标准》（GB 5749-2006）规定阴离子合成洗涤剂含量不超过0.3mg/L（B对ACDE错）。